先兆流产的气血虚弱证的治疗方剂为
A. 寿胎丸
B. 胎元饮
C. 保阴煎
D. 桂枝茯苓丸合寿胎丸
E. 圣愈汤

正确答案：B。胎元饮

解析：先兆流产的气血虚弱证多由于母体气血素虚，或久病大病耗伤气血，或孕后思虑过度，劳倦伤脾，气血生化不足，气血虚弱，冲任匮乏，不能固摄滋养胎元，致胎元不固。治宜补气养血，固肾安胎，方用胎元饮（B对）。先兆流产肾虚证的治疗方剂为寿胎丸（A错）；先兆流产血热证的治疗方剂为保阴煎（C错）；先兆流产血瘀证的治疗方剂宜选用桂枝茯苓丸（D错）加菟丝子、桑寄生、续断；若妊娠期间不慎跌扑闪挫，继则腰腹疼痛，胎动下坠，阴道流血，精神倦怠，脉滑无力，治宜选用圣愈汤（E错）来益气养血，固肾安胎。